上皮隔的形成是上皮根鞘向根尖孔处生长弯曲多少角度形成
A. 90°
B. 60°
C. 50°
D. 45°
E. 30°

正确答案：D。45°

解析：上皮根鞘继续生长并向根尖孔处呈45°角弯曲，形成一个中间有孔的盘状结构，称为上皮隔。掌握“牙体、牙周组织的形成”知识点。